下颌第三磨牙断根进入下颌神经管将损伤
A. 上牙槽后神经
B. 腭前神经
C. 下牙槽神经
D. 舌神经
E. 颊神经

正确答案：C。下牙槽神经

解析：本题考查牙拔除术的并发症-神经损伤。下牙槽神经损伤90%是由拔下颌阻生智齿引起，这是因为下颌第三磨牙根尖距下颌管近，拔牙困难，创伤大；该题中下颌第三磨牙断根进入下颌管，下颌管中有下牙槽神经，故将损伤下牙槽神经（C对）。上牙槽后神经（A错）经翼上颌裂出翼腭窝、进入颞下窝，在上颌结节后面发出上牙龈支至上颌磨牙颊侧的黏膜及牙龈，断根进入下颌神经管不会损伤上牙槽后神经。腭前神经（B错）为腭神经的分支，出腭大孔向前行于上颌骨腭突下面纵行的沟内，因此断根进入下颌神经管不会损伤腭前神经。舌神经（D错）自翼外肌下缘穿出后，紧贴于下颌第三磨牙牙根的下颌骨内面走行，因此断根进入下颌神经管不会损伤舌神经。颊神经（E错）最终在喙突内侧缘沿下颌支前缘向前下行于颊肌的外侧面，断根进入下颌神经管不会损伤颊神经。